某同学通过阅读老师发放的《中学生健康知识手册》学习健康知识。该同学是通过以下哪种健康教育方法获得知识的
A. 传统式健康教育方法
B. 参与式健康教育方法
C. 直接式健康教育方法
D. 间接式健康教育方法
E. 课堂教学

正确答案：D。间接式健康教育方法